黄芩具有而黄柏不具有的功效是
A. 燥湿
B. 泻火
C. 解毒
D. 止血
E. 退虚热

正确答案：D。止血

解析：黄芩的功效是清热燥湿，泻火解毒，止血，安胎。黄柏的功效是清热燥湿，泻火解毒，除骨蒸。两者共同的功效是清热燥湿，泻火解毒；黄芩具有而黄柏不具有的功效是止血（D对）。